职业卫生与职业医学的概念是
A. 预防医学的分支，主要研究如何改善劳动条件
B. 研究职业病的病因、临床表现、诊断和治疗的学科
C. 研究劳动条件对劳动者健康的影响和如何识别、评价和控制不良劳动条件的学科
D. 研究劳动者的生理变化，提高作业能力的学科
E. 研究生产工艺过程对劳动者健康影响的学科

正确答案：C。研究劳动条件对劳动者健康的影响和如何识别、评价和控制不良劳动条件的学科